下列检查对结核性腹膜炎有确诊价值的是
A. PPD试验
B. 血沉检查
C. 结肠镜检查
D. 腹水常规
E. 腹腔镜检查+腹膜活检

正确答案：E。腹腔镜检查+腹膜活检

解析：结核性腹膜炎典型病例可作出临床诊断，予抗结核治疗有效，可确诊。不典型病例，主要是有游离腹水病例，在排除禁忌证后，可行腹腔镜检查并取活检（E对）。PPD试验或T-Spot TB试验阳性有助于结核感染的诊断（A错）。腹水细胞学检查（D错）目的是排除癌性腹水，宜作为常规检查，但不具有确诊意义。血沉检查（增快）（B错）不具有特异性，不作为确诊检查。结肠镜检查（C错）可发现肠粘连、肠结核、肠瘘、肠腔外肿块等征象，对本病有辅助诊断价值。